男，29岁。喜欢吃辣，排便时肛门剧痛1周。有鲜血滴入便池，排便后肛门疼痛加重。最常见于胸膝位
A. 3点
B. 6点
C. 3点和6点
D. 9点
E. 12点

正确答案：E。12点

解析：肛裂最常见于肛门后正中线，故答案选择胸膝位12点（E对）。